下列巨大儿肩难产的处理，错误的是
A. 抑制宫缩
B. 屈大腿
C. 压前肩
D. 牵后臂
E. 做充分大的会阴后斜切开

正确答案：A。抑制宫缩

解析：巨大儿易导致肩难产，临床上很难预测，一旦发生应迅速采取有效助产方法，尽快娩出胎肩，头-体娩出时间间隔的缩短是新生儿存活的关键。首先双侧阴部神经阻滞麻醉并行足够大的双侧会阴后-斜侧切开（E对），使产道松弛。然后助产，方法有屈大腿（B对）可减小对胎肩的牵拉力，是一种基础助产法。压前肩（C对）多与屈大腿助产法合用，有助于嵌顿的前肩娩出。牵后臂（D对）娩出后肩及后上肢，然后轻轻牵拉胎头娩出前肩。抑制宫缩（A错，为本题正确答案）不利于胎儿的娩出。